属于脂肪酸山梨坦类非离子表面活性剂的是
A. 卵磷脂
B. 吐温80
C. 司盘80
D. 卖泽
E. 十二烷基硫酸钠

正确答案：C。司盘80

解析：本题考查表面活性剂。司盘80（C对）为脂肪酸山梨坦类的商品名，为非离子型表面活性剂；卵磷脂（A错）是两性离子型表面活性剂；吐温80（B错）即聚氧乙烯脱水山梨醇单油酸酯，为非离子型表面活性剂；卖泽（D错）即聚氧乙烯脂肪酸酯，为非离子型表面活性剂；十二烷基硫酸钠（E错）为阴离子型表面活性剂。